“益火之源，以消阴翳”适用于
A. 阴偏衰
B. 阳偏衰
C. 阴偏盛
D. 阳偏胜
E. 阴阳两虚

正确答案：B。阳偏衰

解析：阳偏衰，即阳虚，指机体阳气虚损，温煦、推动、气化等功能减退，出现虚寒内生的病机变化。阳虚的病机特点为机体阳气不足，阳不制阴，阴相对偏亢，临床表现为虚寒证，可见畏寒肢冷，小便清长，大便塘薄，舌胖苔白，脉沉迟等症状，即所谓“阳虚则阴盛”“阳虚则寒”。而治疗时多采用扶阳益火之法，以消退阴盛（B对）。